关于牙髓病的临床分类，以下哪一项描述不当
A. 牙髓充血
B. 不可复性牙髓炎
C. 牙髓坏死
D. 牙髓钙化
E. 牙内吸收

正确答案：A。牙髓充血

解析：本题考查牙髓病的临床分类。牙髓充血（A错，为本题的正确答案）属于牙髓病的组织病理学分类，不属于牙髓病的临床分类。根据牙髓病的临床表现和治疗预后进行分类，可分为可复性牙髓炎、不可复性牙髓炎（B对）、牙髓坏死（C对）、牙髓钙化（D对）、牙内吸收（E对）。